不属于婴幼儿期心理发育特点的是
A. 感知发育
B. 言语发育
C. 动作发育
D. 情绪发育
E. 抽象逻辑思维发育

正确答案：E。抽象逻辑思维发育

解析：本题考查婴幼儿期的心理发育特点。抽象逻辑思维发育（E错，为本题正确答案）是青少年期的心理发育特点，具有系统解决问题以及假设性演绎推理的能力。认知发展理论认为，幼儿从出生至2岁左右，大致处于感知发育（A对）阶段。幼儿期心理发展的水平很大程度上取决于言语发育（B对）和动作发育（C对）的发展，情绪的发育（D对）也在幼儿初期基本完成，在整个幼儿时期，情绪体验已相当丰富。但因缺少控制，常表现得较强烈和高涨。